美拉德反应指的是赖氨酸中ε-氨基与下列哪类物质起反应
A. 羧基化合物
B. 羟基化合物
C. 羰基化合物
D. 氨基化合物
E. 烷基化合物

正确答案：C。羰基化合物